在修复前，用牙少量移动的矫治技术简称
A. MTM
B. ATM
C. TMM
D. MAM
E. TMT

正确答案：A。MTM

解析：本题考查修复前准备。在修复前，用牙少量移动的矫治技术（简称MTM）（A对）将有关牙矫治到正常位置后进行修复，能扩大修复治疗的范围，尽量保存牙体组织，明显改善修复预后。